黄体酮的红外吸收光谱，4位烯Vc=0吸收峰的波数是
A. 3500cm⁻¹
B. 2970cm⁻¹
C. 1700cm⁻¹
D. 1615cm⁻¹
E. 870cm⁻¹

正确答案：D。1615cm⁻¹